下列哪项不是“急性脾心痛”的病因病机
A. 外邪侵袭，热积于里
B. 饮食不节，卒伤脾胃
C. 肝胆久病，湿热蕴结
D. 情志失调，肝胆郁气横逆犯胃克脾
E. 蛔虫内扰，肝气胆液蕴积

正确答案：A。外邪侵袭，热积于里

解析：急性脾心痛即为西医的急性胰腺炎，其中医病因病机为饮食不节，卒伤脾胃（B对）；肝胆久病，湿热蕴结（C对）；情志失调，肝胆郁气横逆犯胃克脾（D对）；蛔虫内扰，肝气胆液蕴积（E对），本病病变以脾胃为主，与肝胆关系密切，病机为气滞、湿热，积热壅阻中焦，气机不利，不通则痛，以实证、热证为主（A错，为本题正确答案）。